男，60岁，反复咳嗽12年，活动后气促5个月，咳嗽于每年冬春季发作，每次持续2-3个月，经抗感染治疗可好转，吸烟40余年，约20支/日，查体：双肺呼吸音低，右下肺可闻及少量细湿啰音，胸部X线片示双肺纹理增多，肺功能检查残气量增高，FEV₁/FVC0.55，最可能的诊断是
A. 特发性肺纤维化
B. 肺结核
C. 支气管哮喘
D. 慢性阻塞性肺疾病
E. 支气管扩张

正确答案：D。慢性阻塞性肺疾病

解析：老年男性患者，长期吸烟史（COPD最重要的环境发病因素），反复咳嗽，气促，抗感染治疗可好转，双肺呼吸音低，右下肺可闻及少量细湿啰音，胸部X线片示双肺纹理增多，肺功能检查残气量增高，FEV₁/FVC0.55，最可能的诊断是慢性阻塞性肺疾病（D对）。支气管哮喘（C错）多为儿童或青少年期起病，症状起伏大，常伴有过敏史、鼻炎和（或）湿疹等，部分病人有哮喘家族史。大多数哮喘病人的气流受限有显著的可逆性，合理吸入糖皮质激素等药物常能有效控制病情，是其与慢阻肺相鉴别的一个重要特征。哮喘发作时胸部X线可见两肺透亮度增加，呈过度通气状态，缓解期多无明显异常（P28）。支气管扩张（E错）主要表现为慢性咳嗽、咯大量脓痰和（或）反复咯血。X线检查：囊状支气管扩张的气道表现为显著的囊腔，腔内可存在气液平面（P36）。肺结核（B错）有低热、盗汗等特异症状（P62）。特发性肺纤维化（A错）90%的病人可在双肺基底部闻及吸气末细小的Velcro啰音，胸部X线通常显示双肺外带、胸膜下和基底部分布明显的网状或网结节模糊影，伴有蜂窝样变和下叶肺容积减低（P90）。